选择人工牙后牙（牙合）面解剖形态主要考虑
A. 对颌牙的情况
B. 病人的年龄
C. 病人的要求
D. 牙槽嵴的状况
E. 旧义齿的牙尖高度

正确答案：D。牙槽嵴的状况

解析：本题考查人工后牙的选择。选择人工牙后牙（牙合）面解剖形态主要考虑牙槽嵴的状况（D对）。对颌牙的情况（A错）、病人的年龄（B错）、要求（C错）、旧义齿的牙尖高度（E错）都是相关因素，但是后牙是承受（牙合）力、发挥咀嚼功能的主要部分，其（牙合）面的解剖形态与（牙合）力是否沿牙槽嵴垂直传导及力的大小密切相关，所以主要考虑对牙槽嵴健康状况的影响。